外科辨肿：肿势平坦，根盘散漫，其成因是
A. 火
B. 风
C. 气
D. 郁结
E. 虚

正确答案：E。虚

解析：虚肿：肿势平坦，根盘散漫，常见于正虚不能托毒之疮疡（E对）。热肿（A错）：肿而色红，皮薄光泽，焮热疼痛，肿势急剧，常见于阳证疮疡，如疖疔初期、丹毒等。风肿（B错）：发病急骤，漫肿宣浮，或游走不定，不红微热，或轻微疼痛，常见于痄腮、大头瘟等。气肿（C错）：皮紧内软，按之凹陷，松手即起，似皮下藏气，富有弹性，不红不热，或随喜怒消长，常见于气瘿、乳癖等。郁结（D错）：肿势坚硬，表面不平或有棱角，状如岩突，不红不热。